抗精神病药物的治疗作用与下列通路有关的是
A. 结节-漏斗系统通路
B. 黑质-纹状体通路
C. 中脑-边缘系统通路
D. 小脑-大脑皮质通路
E. 小脑-颞叶系统通路

正确答案：C。中脑-边缘系统通路

解析：脑内多巴胺能系统有四条投射通路：1.中脑边缘通路与抗幻觉妄想等抗精神病作用有关（C对）；2.下丘脑至垂体的结节漏斗通路与催乳素水平升高导致的副作用有关（A错）；3.黑质-纹状体通路与椎体外系副作用有关（B错）；4.中脑皮质通路与药源性阴性症状和抑郁有关。